小于10nm的纳米囊和纳米球可缓慢积集于
A. 肝脏
B. 脾脏
C. 肺
D. 淋巴系统
E. 骨髓

正确答案：E。骨髓

解析：本题考查靶向制剂。

小于10nm的纳米囊和纳米球可缓慢积集于骨髓（E对）。纳米粒包括纳米囊和纳米球，纳米粒经静脉注射，一般被单核-巨噬细胞系统摄取，主要分布于肝、脾、肺，少量进入骨髓。小于10nm的纳米囊与纳米球可缓慢积集于骨髓；200～400nm的纳米粒则缓慢积集于肝后迅速被肝（A错）清除；小于7㎛时一般被肝、脾（B错）中的巨噬细胞摄取；大于7㎛的微粒通常被肺（C错）的最小毛细血管床以机械滤过方式截留；粒径在2.5～10㎛时，大部分积集于巨噬细胞，存在于淋巴系统（D错）中。